黄疸最具特征的表现是
A. 面黄
B. 目黄
C. 小便黄
D. 恶心纳呆
E. 腹胀呕吐

正确答案：B。目黄

解析：黄疸是以目黄、身黄、小便黄为主症的一种病证，其中目睛黄染为本病主要特征（B对）；常伴有食欲减退，恶心呕吐，胁痛腹胀等症状。